属于短效避孕药，但其埋植剂可作为长效避孕药使用的药物是
A. 去氧孕烯
B. 孕二烯酮
C. 左炔诺孕酮
D. 氯地孕酮
E. 地屈孕酮

正确答案：C。左炔诺孕酮

解析：本题考查左炔诺孕酮。属于短效避孕药，但其埋植剂可作为长效避孕药使用的药物是左炔诺孕酮（C对）。去氧孕烯（A错）用于避孕和月经周期调控。孕二烯酮（B错）与炔雌醇组成复方制剂口服，用于避孕。氯地孕酮（D错）为口服强效孕激素，用于避孕。地屈孕酮（E错）用于习惯性流产。